实脾散的功效是
A. 利水渗湿，清热养阴
B. 温肾利湿，分清化浊
C. 温阳健脾，行气利水
D. 利水消肿，理气健脾
E. 利湿化浊，清热解毒

正确答案：C。温阳健脾，行气利水

解析：实脾散方含附子、干姜，温补脾肾以助化气行水，共为君药；臣以茯苓、白术健脾和中，渗湿利水；佐以厚朴、木香、大腹子行气导滞，化湿行水；同时配草果温中燥湿，木瓜除湿醒脾和中，甘草、生姜、大枣益脾和中。诸药共奏温阳健脾，行气利水（C对），主治脾肾阳虚，水气内停之阴水。